能够导致恒牙变成四环素牙的时间是
A. 胚胎8周
B. 胚胎29周之前
C. 胚胎29周至出生
D. 出生之前
E. 出生至8岁之前

正确答案：E。出生至8岁之前

解析：在出生至8岁之间摄入四环素，可导致恒牙变色，故在此期间特别注意慎用四环素。掌握“四环素牙”知识点。